男，30岁，火焰烧伤全身3h，烧伤总面积95%，其中Ⅲ度80%，伤后无尿，未行其他任何处理。首选治疗方案是上述哪项
A. 气管切开
B. 气管插管
C. 鼻饲给氧
D. 静脉切开或静脉穿刺插管
E. 静脉穿刺

正确答案：D。静脉切开或静脉穿刺插管

解析：患者大面积烧伤，急救时应该首选补液。掌握“火器伤、热烧伤”知识点。